皮肤致敏试验最常用的动物是
A. 大鼠
B. 豚鼠
C. 兔
D. 小鼠
E. 犬

正确答案：B。豚鼠